女，68岁。进行性记忆力下降5年。近半年多次因忘关天然气而引起厨房失火，想不起常用日用品的名称，整日在家找东西，将家里弄得乱七八糟，并怀疑儿媳偷东西。既往体健，家族无类似疾病者，查体无阳性体征。辅助检查：头部CT示脑萎缩，Hachinski缺血指数数量表（HIS）评分：3分。患者最可能的诊断是
A. 阿尔茨海默病
B. 假性痴呆
C. 妄想性障碍
D. 血管性痴呆
E. 精神分裂症

正确答案：A。阿尔茨海默病

解析：患者老年女性，进行性记忆力下降5年，近半年多次因忘关天然气而引起厨房失火，想不起常用日用品的名称（记忆力进行性下降为阿尔茨海默病的典型症状）。整日在家找东西，并怀疑儿媳偷东西（被窃妄想和嫉妒妄想是AD最常见的妄想症状），Hachinski缺血指数数量表（HIS）评分：3分（HIS为3～4分，疑为脑血管性痴呆）。查体无阳性体征。辅助检查：头部CT示脑萎缩（阿尔茨海默病的典型影像学表现），根据患者的病史、症状和辅助检查，考虑诊断为阿尔茨海默病（A对）。假性痴呆（B错）是指伴随意识障碍而出现的暂时性脑机能障碍，并非真正的智能缺损，常突然发生，也可突然消失，一般维持时间较短。妄想性障碍（C错）又称为偏执性精神病，妄想为一种或一整套相互关联的内容，在不涉及妄想内容的情况下，患者不表现明显的精神异常，一般不会出现智能障碍和人格缺损。血管性痴呆（D错）是由脑血管病变导致的痴呆，体格检查可有局灶性神经系统症状和体征。精神分裂症（E错）多起病于青壮年，其基本症状为“4A”症状即联想障碍、情感淡漠、矛盾意向及内向性，一般无智能障碍。